彻底去除牙石主要是因为牙石
A. 可直接引起牙周袋
B. 可引起牙龈退缩
C. 内含各种炎症因子和细菌毒素
D. 是菌斑滞留堆积的部位
E. 以上均是

正确答案：D。是菌斑滞留堆积的部位

解析：本题考查牙石的致病作用。牙石表面粗糙，是菌斑滞留堆积的部位（D对），而菌斑是牙周病的始动因子，其借助牙石刺激牙周组织引起牙周炎症,去除牙石的同时能将附着在其上的菌斑一并去除，因此牙周治疗时应彻底去除牙石。虽然牙石本身对牙龈有一定机械刺激，但其并不会可直接引起牙周袋（A错），在菌斑的作用下才会直接引起牙周袋。牙石的机械刺激会引起牙龈退缩（B错），但彻底去除牙石的主要原因是去除菌斑的滞留的理想表面，预防和治疗牙周病。牙石的主要成分是钙、磷等无机盐，不会致病，致病的是聚集在牙石表面的细菌生长代谢产生的各种炎症因子和细菌毒素（C错），因此去除牙石的同时将致病因素-菌斑一并去除。